经空气传播的传染病
A. 发病往往有年龄差异
B. 有时可造成暴发流行
C. 两种流行特征都有
D. 两种流行特征都无

正确答案：C。两种流行特征都有

解析：本题考查经空气传播的传染病的流行特征。经空气传播的传染病是呼吸道传染病的主要传播方式，包括经飞沫、飞沫核和尘埃传播，其发病往往有年龄差异，有时可造成暴发流行（C对ABD错）。